两种疗法治疗某种疾病疗效比较，当n=24时，检验两种疗法疗效有无差别，可采用
A. t检验
B. 秩和检验
C. 成组设计四格表资料的χ²检验
D. 配对资料四格表资料的χ²检验
E. 直接计算概率法

正确答案：E。直接计算概率法